药库接收了一批药品，其中需要冷处贮存的是
A. 西地碘片
B. 硫普罗宁片
C. 双歧三联活菌胶囊
D. 乳酶生片
E. 托烷司琼注射液

正确答案：C。双歧三联活菌胶囊

解析：本题考查药品的贮存。双歧三联活菌胶囊（C对）需要在冷处贮存，不宜冷冻。西地碘片（A错）易吸湿，需防潮处理。硫普罗宁（B错）、乳酶生片（D错）、托烷司琼注射液（E错）均易受温度影响，需要在凉暗处贮存。